目前临床上最广泛应用的免疫抑制药
A. 硫唑嘌呤
B. 环孢素（CsA）
C. 环磷酰胺
D. 糖皮质激素
E. FK-506

正确答案：B。环孢素（CsA）

解析：防治移植排斥反应最有效的措施是给予免疫抑制药，如糖皮质激素、环孢素（CsA）、FK506、西罗莫司和环磷酰胺等，其中CsA是目前临床上最广泛应用的免疫抑制药，其作用机制是直接或间接抑制Th细胞IL-2等细胞因子，抑制活化的T细胞表达IL-2受体。掌握“移植免疫”知识点。